生化汤治疗血被寒凝，瘀阻胞宫而致的产后恶露淋漓不爽，常加用的药物是
A. 桃仁、赤芍
B. 红花、赤芍
C. 蒲黄、五灵脂
D. 蒲黄、益母草
E. 黑荆芥、茜草

正确答案：D。蒲黄、益母草

解析：血被寒凝，瘀阻胞宫而致的产后恶露淋漓不爽，寒凝血流不畅，而为淤，产后恶露不绝血瘀证，治宜活血化瘀止血，方选生化汤加益母草、炒蒲黄。方中为增强祛瘀止血之功加益母草、炒蒲黄（D对）。桃仁、赤芍能活血祛瘀，无止血之功，且桃仁为生化汤的组成（A错）。红花、赤芍能活血祛瘀，无止血之功（B错）。五灵脂功长于破血行血，产后本就津血损伤，应慎用破血行血药（C错）。黑荆芥能止血，无祛瘀之功，茜草性寒，用于血热血瘀证而非寒凝血瘀（E错）。